芳基丙酸类药物最主要的临床作用是
A. 中枢兴奋
B. 抗癫痫
C. 降血脂
D. 抗病毒
E. 消炎镇痛

正确答案：E。消炎镇痛

解析：本题考查芳基丙酸类药物。芳基丙酸类药物属于芳基烷酸类非甾体抗炎药，主要用于消炎镇痛。中枢兴奋（A错）的临床常用药物有咖啡因、尼可刹米等。抗癫痫（B错）的临床常用药物有苯妥英钠、卡马西平等。降血脂（C错）的临床常用药物有考来烯胺、氯贝丁酯等。抗病毒（D错）的临床常用药物有阿昔洛韦、利巴韦林等。